成人每周应至少参加多少分钟中等强度的身体活动
A. 90
B. 120
C. 150
D. 200
E. 250

正确答案：C。150

解析：根据目前的科学证据，中等强度活动至少每周5天对于健康的促进具有非常重要的作用，而每天30分钟中等强度的身体活动，如4~7km/h的快走和小于7km/h的慢跑，可以降低心血管病､糖尿病､结肠癌和乳腺癌等慢性病的风险和病死率，故答案应该是30*5=150分钟(C对）｡